与金属基托比较，塑料基托
A. 美观，温度传导好，舒适，易自洁，强度差
B. 美观，温度传导差，舒适，易自洁，强度差
C. 美观，温度传导好，舒适，不易自洁，强度差
D. 美观，温度传导好，不舒适，易自洁，强度差
E. 美观，温度传导差，不舒适，不易自洁，强度差

正确答案：E。美观，温度传导差，不舒适，不易自洁，强度差

解析：塑料基托：材料为甲基丙烯酸甲酯。优点：色泽美观，近似黏膜，操作简便，价廉，重量轻，便于修理、添加和重衬。缺点：强度差，受力大时易折裂；温度传导作用差，且不易自洁。金属基托：由金属铸造或锤造而成，多用铸造法制作。常用材料为钴铬合金、钛合金和纯钛金属。优点：强度高，不易折裂；体积小且薄，患者戴用较舒适，温度传导作用好。缺点：制作工艺较复杂，不易修理和添加，无法重衬。掌握“局部义齿人工牙及基托”知识点。